男性，27岁，尿频，尿急，尿痛1年，一般抗炎治疗不好转，时有低热无力，尿检：白细胞20～30/HP，红细胞5～8/HP，肾图：右肾严重受损，左肾积水，初诊为肾结核。检查结果左肾功能不佳，现在最佳的治疗是
A. 右肾切除
B. 左肾造瘘
C. 结核药物治疗
D. 右肾切除，左肾造瘘
E. 抗结核治疗+左肾造瘘

正确答案：E。抗结核治疗+左肾造瘘

解析：青年男性患者，诊断为右肾结核，左肾积水。肾图示右肾已严重受损，考虑需行右肾切除。患者时有低热无力，尿检：白细胞20～30/HP（高于正常值0～5/HP），红细胞5～8/HP（高于正常值0～3/HP），提示结核仍处于活动期。故此时需行结核药物治疗，一段时间后待结核症状稳定，择期切除受损严重的右肾。左肾积水，且已有左肾功能不佳，故应尽早引流肾积水，保护左肾功能。故现在最佳的治疗是抗结核治疗+左肾造瘘（E对）。右肾切除（AD错）需待肾功能好转后才能进行，否则病人手术耐受性差，易造成危险。患者此时正处于结核活动期，左肾造瘘（B错）易导致结核感染扩散。结核药物治疗（C错）可以控制结核病情的活动，但不能改善左肾功能。